中医学认为人体生命的本原物质是
A. 血液
B. 津液
C. 精汁
D. 精气
E. 水谷精微

正确答案：D。精气

解析：精，又称精气，在中国古代哲学中，一般泛指气，是一种充塞宇宙之中的无形而运动不息的极细微物质，是构成宇宙万物的本原；在某些情况下专指气中的精粹部分，是构成人类的本原（D对）。血（A错）是循行于脉中而富有营养的红色液态物质，是构成人体和维持人体生命活动的基本物质之一。津液（B错）是机体一切正常水液的总称，包括各脏腑形体官窍的内在液体与其正常的分泌物，津液是构成人体和维持生命活动的基本物质之一。调畅胆汁的分泌排泄胆汁，又称“精汁”（C错），由肝之精气汇聚而成。水谷精微（E错），泛指人体消化吸收的营养物质，是人体从事劳动、维持体温的能量来源，并为生长、发育、生殖提供新建和重建的原料，也是人体生命活动的维持和精、气、血、津的化生的主要物质基础。